根据实验研究和流行病调查，诱发人类癌症主要是与
A. 病毒因素有关
B. 放射性因素有关
C. 物理因素有关
D. 化学因素有关
E. 遗传因素有关

正确答案：D。化学因素有关

解析：本题考查诱发人类癌症的主要因素。根据实验研究和流行病调查，诱发人类癌症主要是与化学因素有关（D对ABCE错）。化学因素主要是指各种化学物质可诱发癌症，例如苯、二甲苯可诱发白血病；黄曲霉素、亚硝胺可诱发肝癌、胃癌等肿瘤。